以下哪项是指在促使人们自愿采纳有益于健康的行为和生活方式，从而预防疾病、促进健康、提高生活质量的系统的社会活动
A. 健康检查
B. 疾病预防
C. 社区保健
D. 社区免疫
E. 健康教育

正确答案：E。健康教育

解析：健康教育是指在促使人们自愿采纳有益于健康的行为和生活方式，从而预防疾病、促进健康、提高生活质量的系统的社会活动。掌握“干预基本模式及烟草行为干预”知识点。